细菌性肝脓肿的典型表现是
A. 胆囊肿大
B. 甲胎蛋白阳性
C. 右上腹绞痛及黄疸
D. 肝穿刺抽出棕褐色脓液
E. 突发寒战高热，肝区疼痛，肝肿大

正确答案：E。突发寒战高热，肝区疼痛，肝肿大

解析：细菌性肝脓肿由细菌感染引起，主要表现为发寒战高热，肝区疼痛，肝肿大（E对）。细菌性肝脓肿多不引起胆道梗阻或引起胆囊炎，较少出现胆囊肿大（A错）。甲胎蛋白阳性（B错）多见于肝癌。右上腹绞痛及黄疸（C错）常见于急性胆管炎。肝穿刺抽出棕褐色脓液（D错）是阿米巴肝脓肿的表现。